某男，40岁。腹满痛拒按，潮热谵语，但下利清水。辨证为热结旁流，病机为“大实有羸状”，属于
A. 实中夹虚
B. 虚中夹实
C. 真虚假实
D. 真实假虚
E. 因虚致实

正确答案：D。真实假虚

解析：本题考查的是邪正盛衰与疾病的转归。病机为“大实有羸状”，属于真实假虚（D对）。在特殊情况下，病变可出现本质与表现不一致的虚实真假变化，这对于全面认识疾病的发展及转化具有重要意义。1.虚实变化：在疾病的发展变化过程中，正气和邪气这两种力量不是固定不变的，而是正邪双方在其斗争的过程中，在力量对比上发生着消长盛衰的变化。一般来说，正气增长而旺盛，则必然促使邪气消退，反之，邪气增长而亢盛，则必然会损耗正气。随着体内邪正的消长盛衰，形成了病证的虚实变化。（1）实：实，即邪气亢盛，是以邪气盛为矛盾主要方面的病机变化。致病邪气的毒力和机体的抗病能力都比较强盛，或是邪气虽盛而机体的正气未衰，能积极与邪抗争，故正邪相搏，斗争剧烈，反应明显，在临床上出现一系列病变性反应比较剧烈有余的证候，即谓之实证。实证常见于外感六淫致病的初期和中期，或由于痰、食、水、血等滞留于体内而引起的病证。例如，痰涎壅盛、食积不化、水湿泛滥、瘀血内阻等病变，以及壮热、狂躁、声高气租、腹痛拒按、二便不通、脉实有力等，都属于实证。（2）虚：虚，即正气不足，是以正气虚损为矛盾主要方面的病机变化。也就是说，机体的气、血、津液和经络、脏腑等生理功能较弱，抗病能力低下，因而机体的正气对于致病邪气的斗争，难以出现较剧烈的病变反应。所以，临床上可出现一系列虚弱、衰退和不足的证候，即谓之虚证。虚证多见于素体虚弱或疾病的后期，以及多种慢性病证。例如，大病、久病消耗精气，或大汗、吐利、大出血等耗伤人体气血津液、阴阳，均会导致正气虚弱，出现神疲体倦、面容憔悴、心悸气短、自汗、盗汗，或五心烦热，或畏寒肢冷、脉虚无力等正虚的临床表现。2.虚实错杂：（1）实中夹虚（A错）：实中夹虚，是指以邪实为主，兼见正气虚损的病机变化。例如，外感热病发展过程中，由于邪热炽盛，消灼津液而形成的实热伤津、气阴两伤病证，出现高热、烦渴欲饮、尿少便干等表现，就属于实中夹虚的病机变化。（2）虚中夹实（B错）：虚中夹实，是指以正虚为主，兼夹邪实的病机变化。例如，脾阳不振，运化无权之水肿病，即属此类。这是由于脾失健运，气不化水，水湿停聚，泛溢肌肤所致。因为水湿之邪滞留于体内，故称之为实，但其邪实乃由脾虚不运所致，故其病变变化仍以虚为主，而邪实则居其次，属于虚中夹实的病证。3.虚实转化：（1）由实转虚：由实转虚，是指因疾病失治或治疗不当，以致病邪久留，损伤人体正气，导致疾病由实转化为虚。例如，实热证大量耗伤阴液，可转化为虚热证。（2）因虚致实（E错）：因虚致实，是指因正气不足，无力驱邪外出，或正虚而内生水湿、痰饮、瘀血等病变产物的凝结阻滞，导致疾病由虚转化致实。例如，肺肾两虚的哮证，肺卫不固，复感风寒，哮喘复发，而见寒邪束表，痰涎壅肺证。4.虚实真假：（1）真实假虚：又称“大实有羸状”，是指病机的本质为“实”，但表现出“虚”的临床假象的病机变化。一般是由于邪气亢盛，结聚体内，阻滞经络，气血不能外达所致。例如，热结肠胃，一方面出现腹痛硬满拒按、大便秘结、潮热、谵语等实热症状，同时因阳气被遏，不能外达，可见面色苍白、四肢逆冷、精神委顿等状似虚寒的假象。（2）真虚假实（C错）：又称“至虚有盛候”，是指病机的本质为“虚”，但表现出“实”的临床假象的病机变化。一般是由于正气虚弱，脏腑经络气血不足，功能减退，气化无力所致。例如，脾气虚弱，运化无力，可见脘腹胀满、疼痛等假实征象。又如，老年或大病久病，因气虚推动无力而出现的便秘等。分析病机的虚或实，必须透过现象看本质，才能不被假象所迷惑，真正把握住疾病的虚实变化。